理气药的性味多为
A. 苦、寒
B. 甘、寒
C. 辛、苦、温
D. 甘、苦、温
E. 甘、辛、温

正确答案：C。辛、苦、温

解析：该题考查的是理气药的性味，属记忆内容。理气药性味多辛苦温而芳香（C对）。